最易发生闭塞的血管是
A. 大脑后动脉
B. 眼动脉
C. 大脑前动脉
D. 椎-基底动脉
E. 大脑中动脉

正确答案：E。大脑中动脉